流行性感冒的传播途径有
A. 空气飞沫
B. 饮水
C. 母婴传播
D. 血源性
E. 食物

正确答案：A。空气飞沫

解析：本题考查流行性感冒的传播途径。流行性感冒是一种由流感病毒引起的常见急性呼吸道传染病。主要通过飞沫传播（A对BCDE错），一般通过空气中的飞沫、人与人之间的接触或与被污染物品的接触传播。